单纯收缩期高血压水平范围是
A. 收缩压120～139mmHg舒张压80～89mmHg
B. 收缩压140～159mmHg舒张压90～99mmHg
C. 收缩压160～179mmHg舒张压100～109mmHg
D. 收缩压≥180mmHg舒张压≥110mmHg
E. 收缩压≥140mmHg舒张压＜90mmHg

正确答案：E。收缩压≥140mmHg舒张压＜90mmHg

解析：本题考查血压水平分类与定义。单纯收缩期高血压水平范围是收缩压≥140mmHg舒张压＜90mmHg（E对）。收缩压120～139mmHg和（或）舒张压80～89mmHg（A错）为正常高值。收缩压140～159mmHg和（或）舒张压90～99mmHg（B错）为1级高血压（轻度）。收缩压160～179mmHg和（或）舒张压100～109mmHg（C错）为2级高血压（中度）。收缩压≥180mmHg和（或）舒张压≥110mmHg（D错）为3级高血压（重度）。